氟牙症临床表现说法错误的是
A. 多发生于恒牙
B. 可出现白色斑纹
C. 釉质牙本质变脆
D. 对酸蚀抵抗力较弱
E. 严重者出现牙实质性缺损

正确答案：D。对酸蚀抵抗力较弱

解析：氟牙症多发生在恒牙，乳牙较少。受损釉质可出现白色斑纹，甚至整个牙为白垩样釉质；有的牙出现黄褐色；严重者出现牙实质性缺损以致牙失去整体外形，其严重程度取决于过量摄入氟的程度。釉质和牙本质变脆，耐磨性差，但对酸蚀的抵抗力较强。掌握“氟毒性及氟牙症”知识点。